肿疡基底部周围之坚硬区，称为
A. 创面
B. 疽
C. 根盘
D. 根脚
E. 护场

正确答案：C。根盘

解析：根盘指肿疡基底部周围之坚硬区，边缘清楚（C对）。创面（A错）创伤的表面。疽（B错）指气血被毒邪阻滞而发于皮肉筋骨的疾病。常见的有有头疽和无头疽两类。根脚（D错）指肿疡之基底根部。一般多用于有头疽或疔的基底部的描述。护场（E错）指在疮疡的正邪交争过程中，正气能够约束邪气，使之不至于深陷或扩散所形成的局部肿胀范围。